临床试验属于
A. 流行病学的观察法
B. 流行病学的实验法
C. 流行病学的理论与方法学研究
D. 统计分析法
E. 基础实验法

正确答案：B。流行病学的实验法

解析：本题考查流行病学分类方法。临床试验属于流行病学研究方法中的实验法（B对ACDE错）中实验流行病学中的一类，有验证假设的作用。